治疗肠梗阻水结湿阻证首选
A. 复方大承气汤
B. 小承气汤
C. 增液承气汤
D. 甘遂通结汤
E. 麻子仁丸

正确答案：D。甘遂通结汤

解析：肠梗阻水结湿阻证治疗应攻逐水饮散结。可用甘遂通结汤加减（D对）。复方大承气汤（A错）适用于肠梗阻肠腑热结证。小承气汤（B错）治疗伤寒阳明证，谵语便硬，潮热而喘者。增液承气汤（C错）用于大便不通，热结阴亏者。麻子仁丸（E错）主要用于肠胃燥热，津液不足，大便干结，小便频数者。